由宋代官府颁行的我国第一部成药典是
A. 《神农本草经》
B. 《本草纲目》
C. 《太平圣惠方》
D. 《千金翼方》
E. 《太平惠民和剂局方》

正确答案：E。《太平惠民和剂局方》

解析：本题考查的是《太平惠民和剂局方》。由宋代官府颁行的我国第一部成药典是《太平惠民和剂局方》（E对）。《太平惠民和剂局方》：简称《和剂局方》《局方》，宋代太医局编。全书10卷。该书为宋代官府颁行，是我国第一部成药典。该书对后世影响颇大，其所载方剂至今在临床上多有应用。《神农本草经》（A错）：简称《本经》《本草经》《神农本草》。托名神农氏撰，约成书于东汉时期（公元25～219年），非一时一人所作。全书共3卷，序例1卷。该书序例部分，包括药物三品分类原则、君臣佐使配合、七情、四气五味、采造时月、真伪新陈、药性调剂宜忌、用药察源、毒药用法、用药大法、服药时间、大病之主等。载药365种。该书是最早的本草学专著，具有重要的科学价值和历史影响，为我国医药学四大经典著作之一。《本草纲目》（B错）：简称《纲目》，明·李时珍著，成书于1578年。此书可谓中药学巨著，内容广博，收罗繁富。全书引据历代本草凡84家，古今医书目277种，另从经史子集各部著作中引录了大量有关的文献资料，参考文献共计800余种。书中共收载药物1892种，方剂11096首，附有药物图谱1109幅。问世后被全部或部分译成日、朝、英、法、意、俄等多种文字。《太平圣惠方》（C错）：宋·王怀隐等编。全书共100卷，分1670门，收方16834首。该书以临床实用为目的，首详诊脉辨阴阳法，次叙处方用药法则，然后按科分叙各科病证和病因、病理以及方药的适应证和药物剂量。因证设方，药随方施，理法方药兼收并蓄。《千金翼方》（D错）：唐•孙思邈撰著于公元682年。该书是《千金要方》的续编，与《千金要方》相辅相成。全书30卷。该书与《千金要方》对后世中医学发展具有重要的影响。